引起严重肝病的病因
A. 酒精
B. 四氯化碳
C. 肝炎病毒
D. 遗传性肝病
E. 以上都是

正确答案：E。以上都是

解析：引起严重肝病的病因包括酒精（A对）、四氯化碳（B对）、肝炎病毒（C对）及遗传性疾病（D对）等等。综上，以上都是（E对）引起严重肝病的病因。